在评价大气质量的方法中，有一类指数的各分指数与其实测浓度呈分段线性函数关系，指数的表示也以各分指数分别表示或选择最高的表示，并赋予其健康效应含义和应采取的措施。这类指数中最早报道、最有代表性的是
A. PSI
B. AQI
C. WQI
D. EQI
E. PAI

正确答案：A。PSI

解析：本题考查污染物标准指数（PSI）。在评价大气质量的方法中，污染物标准指数（PSI）（A对BCDE错）的各分指数与其实测浓度呈分段线性函数关系，指数的表示也以各分指数分别表示或选择最高的表示，并赋予其健康效应含义和应采取的措施，而且是最早报道、最有代表性的。